菌体由两个以上弯曲，长3～6μm的是
A. 弧菌
B. 螺菌
C. 螺杆菌
D. 弯曲菌
E. 杆菌

正确答案：B。螺菌

解析：螺形菌分为：①弧菌，为弧状或逗点状，只有一个弯曲，长2～3μm，如霍乱弧菌；②螺菌，菌体由两个以上弯曲，长3～6μm，如鼠咬热螺菌；③螺杆菌，呈螺旋状弯曲，长2.5～4.0μm，如幽门螺杆菌。掌握“细菌的特殊结构及检查方法”知识点。